单块肌肉外面包有的结缔组织称为
A. 肌外膜
B. 肌间膜
C. 肌内膜
D. 肌束膜
E. 无

正确答案：A。肌外膜

解析：单块肌肉外面包有的结缔组织称为肌外膜（A对）。肌内膜（C错）是指分布在每条肌纤维外面的结缔组织；肌束膜（D错）是指肌外膜伸入肌内，将其分隔形成肌束，包裹肌束的结缔组织。